暴露于酸性工作环境中的人易患
A. 酸蚀症
B. 龋病
C. 骨质疏松
D. 牙周病
E. 氟牙症

正确答案：A。酸蚀症

解析：本题考查酸蚀症。暴露于酸性工作环境中的人易患酸蚀症（A对）。牙酸蚀症是指在无细菌参与的情况下，由于接触牙面的酸或其螯合物的化学侵蚀作用而引起的一种慢性的、病理性的牙体硬组织丧失。暴露于酸性工作环境中的人易患酸蚀症。龋病（B错）是在以细菌为主的多种因素影响下，牙体硬组织发生慢性进行性破坏的一种疾病。牙周病（D错）是一种多因素疾病，牙菌斑生物膜是主要的致病因素。氟牙症（E错）又称氟斑牙或斑釉症，是在牙发育矿化时期机体摄入过量的氟所引起的一种特殊的牙釉质发育不全，是地方性慢性氟中毒最早出现的体征。